长期维生素B1缺乏引起心衰的主要原因是
A. 心肌各成份的不平衡生长
B. 心肌中大量收缩蛋白破坏
C. 心肌兴奋收缩耦联障碍
D. 心肌能量生成障碍
E. 上述均可能存在

正确答案：D。心肌能量生成障碍

解析：长期维生素B1缺乏时，心肌细胞有氧氧化障碍，导致ATP生成不足（心肌能量生成障碍）（D对），心肌收缩性降低，久之可引起心衰。